重组可溶型TNF受体可治疗类风湿关节炎此方法属于
A. 治疗用抗原
B. 抗毒素血清
C. 治疗用细胞因子
D. 治疗用可溶性细胞因子受体
E. 治疗用非特异性免疫增强剂

正确答案：D。治疗用可溶性细胞因子受体

解析：治疗用可溶性细胞因子受体：重组可溶型TNF受体可治疗类风湿关节炎，缓解感染性休克；重组可溶型IL-1受体可抑制器官移植排斥反应。掌握“免疫预防及免疫治疗”知识点。